丘脑的非特异性投射系统的主要作用是
A. 引起痛觉
B. 引起温度觉
C. 引起触觉
D. 使机体进入睡眠状态
E. 维持大脑皮层的兴奋状态

正确答案：E。维持大脑皮层的兴奋状态

解析：非特异投射系统是指丘脑非特异投射核及其投射至大脑皮层的神经通路，主要功能是维持大脑皮层兴奋状态（E对），切断该系统可使机体进入睡眠状态（D错）。该系统经多次换元并弥散性投射到大脑皮层广泛区域，因而与皮层不具有点对点的投射关系。因该系统没有专一的感觉传导功能，因为不能引起痛觉（A错）、温度觉（B错）和触觉（C错）等特定的感觉。